代表乙肝病毒（HBV）复制最重要的血清指标是
A. HBsAg（+）
B. HBeAg（+）
C. 抗HBc（+）
D. 抗HBs（+）
E. 抗HBe（+）

正确答案：B。HBeAg（+）

解析：HBV复制的时候，DNA含量会显著增加，所以临床上一般采取HBV DNA作为HBV复制的灵敏指标，同时，HBcAg和HBeAg均会增加。但由于HBcAg表达于肝细胞内，血清中不能检测出游离的HBcAg，故临床价值不大。因此HBeAg也就成为目前临床上反映HBV复制和传染性较好的指标，HBeAg阳性表示HBV复制活跃且有较强传染性（B对）。HBsAg存在于病毒包膜，不是病毒复制的主体，因此HBsAg（+）（A错）不能反映HBV的复制状况和传染性，反映的是HBV现症感染。血清中不能检测出HBcAg，但由于HBcAg的抗原性很强，感染HBV后机体会很快产生特异性抗体，包括抗HBc IgM和抗HBc IgG。单纯抗HBc IgM（C错）阳性表示新近感染；单纯抗HBc IgG（C错）阳性表示既往感染；两种都阳性表示慢性感染现在急性发作。抗HBe（+）（E错）表示机体产生了对HBV的免疫清除作用，病毒复制减弱、传染性降低。HBsAg没有传染性，有抗原性。抗HBs（D错）为保护性抗体，抗Hbe（+）表示机体对HBV有免疫力。